牙内吸收的原因尚不明了，但常可见于
A. 受过外伤的牙
B. 再植牙
C. 活髓切断术后的牙
D. 盖髓术后的牙
E. 以上都是

正确答案：E。以上都是

解析：牙内吸收的原因不明，多发生于受过外伤的牙齿、再植牙及做过活髓切断术或盖髓术的牙齿。掌握“牙髓坏死、牙髓钙化与牙内吸收”知识点。